治疗崩漏实热证，应首选
A. 保阴煎
B. 固本止崩汤
C. 清热固经汤
D. 清热调血汤
E. 左归丸

正确答案：C。清热固经汤

解析：清热固经汤主要功效是清热凉血，固冲止血，方药配伍集清热、泻火、凉血、育阴、祛瘀、胶固、炭涩、镇潜、补任、固冲多种止血法，能清热凉血，固冲止血，治疗血热型崩漏（C对）。保阴煎主要功效为清热凉血，固冲止血，本方加减主要用于治疗月经过多、胎漏、胎动不安和恶露不绝血热证（A错）。固本止崩汤主要治疗气虚血崩昏暗，以补气摄血，固冲止崩（B错）。清热调血汤，原方治“经水将来，腹中阵阵作痛，乍作乍止，气血俱实”，主要功效是清热除湿，化瘀止痛，多用于治疗痛经湿热瘀阻证（D错）。左归丸主要功效为治真阴肾水不足，滋肾养阴，合二至丸可用于治疗崩漏肾阴虚证（E错）。